非刺激性唾液缓冲系统中，最重要的为
A. 磷酸盐系统
B. 碳酸盐系统
C. 硫酸盐系统
D. 碳酸氢盐系统
E. 氯离子系统

正确答案：A。磷酸盐系统

解析：磷酸盐系统是非刺激性唾液中最重要的缓冲系统。掌握“龋病预测与早期诊断”知识点。